舌黏膜中是味觉感受器的结构是
A. 丝状乳头
B. 菌状乳头
C. 轮廓乳头
D. 叶状乳头
E. 味蕾

正确答案：E。味蕾

解析：轮廓乳头：约10个左右，沿界沟的前方排列成一行。在乳头的环沟侧壁上皮内，有许多染色浅淡的卵圆形小体，称味蕾，有感受味觉的功能。掌握“口腔黏膜分类及组织结构”知识点。